豆类中含有的具有抗氧化、抗肿瘤等多种作用的物质是
A. 维生素
B. 矿物质
C. 抗营养因子
D. 豆类蛋白
E. 生物活性物质

正确答案：E。生物活性物质